医学伦理学的研究内容在不断变化与丰富，但概括起来主要是指
A. 医学伦理理论
B. 医学伦理实践
C. 医学伦理规范
D. 医学伦理难题
E. 以上说法均正确

正确答案：E。以上说法均正确

解析：伴随着社会变迁，医学伦理学的研究内容在不断变化与丰富，但概括起来主要包括：医学伦理理论；医学伦理关系；医学伦理规范；医学伦理实践；医学伦理难题。掌握“医学伦理学”知识点。